患者，女，26岁，已婚。产后3天高热寒战，小腹疼痛拒按，恶露初时量多，后量少、色紫黯如败酱、有臭气，烦躁口渴，溺赤便结，舌红苔黄，脉滑数有力。其诊断是
A. 产后发热外感证
B. 产后发热血瘀证
C. 产后腹痛血瘀证
D. 产后恶露过少血瘀证
E. 产后发热感染邪毒证

正确答案：E。产后发热感染邪毒证

解析：患者产后三天高热寒战，是为产后发热证，小腹疼痛拒按，恶露或多或少，是邪毒入胞与瘀血互结，阻滞胞脉；色紫黯如败酱，有臭气，是因为热与血结，热毒熏蒸；烦躁口渴，溺赤便结，舌红苔黄，脉滑数有力均为邪毒内燔之象（E对）。产后发热外感证主要表现为产后恶寒发热，鼻流清涕，头痛，肢体酸痛，无汗，舌苔薄白，脉浮紧（A错）。产后发热血瘀证主要表现为产后寒热时作，恶露不下或下亦甚少，色紫黯有块，小腹疼痛拒按。舌质紫黯或有瘀点，脉弦涩（B错）。产后腹痛血瘀证主要表现为产后小腹疼痛，拒按，得热痛缓；恶露量少，涩滞不畅，色紫黯有块，块下痛减；面色青白，四肢不温，或伴胸胁胀痛；舌质紫黯，脉沉紧或弦涩（C错）。产后恶露过少血瘀证多表现为产后恶露量少，色紫黯，有血块，小腹多为胀痛，血块排除后胀痛减轻，舌紫暗有瘀斑或瘀点，脉沉弦或沉涩（D错）。